患者，1周前因外伤前牙折断，已经作过根管治疗。检查：冠折，断面在龈上，无叩痛，无松动，牙片显示根充完善，无根折。该牙应在根管治疗后多长时间进行桩冠修复
A. 1天
B. 3天
C. 1周
D. 2周
E. 1个月

正确答案：C。1周

解析：本题考查桩冠修复的时机。经过成功根管治疗的患牙，治疗后应观察1-2周，确定无临床症状后，才可以进行桩冠修复（C对），若修复过早如根管治疗后1天（A错）、三天（B错），牙髓症状未完全消失，根尖病变未完全愈合，易导致根管治疗失败，重新行桩冠修复。若如患者有瘘管，需等到瘘管完全闭合后，而且无临床根尖周症状时才可做桩冠修复。若桩冠修复过晚如根管治疗后两周（D错）、一个月（E错），会引起邻牙移位对颌牙伸长，影响以后修复治疗。